患者，男，45岁。平日急躁易怒，今日因事与人争吵时突感头晕，站立不住，面赤如醉，舌体颤动，脉弦。其证候是
A. 肝火上炎
B. 肝阳上亢
C. 热极生风
D. 肝阳化风
E. 肝气郁结

正确答案：D。肝阳化风

解析：肝阳化风证以眩晕、肢麻震颤、头胀痛、面赤，甚至突然昏仆、口眼㖞斜、半身不遂等为辨证的主要依据。患者肝阳上亢，阴不制阳，阳亢化风，则头晕；因生气，阳亢而气血上壅，上实下虚，则行走漂浮，步履不稳；气血壅滞络脉，则面赤如醉；风动筋脉挛急，阴亏舌脉失养，则舌体颤动；阳亢阴虚化风，则脉弦。故患者为肝阳化风证（D对）。肝火上炎证指火热炽盛，内扰于肝气火上逆，以头痛、烦躁、耳鸣、胁痛等与实热症状为主要表现的证候。患者头晕，站立不住，舌体颤动等症状是阴不制阳，阳亢日久化风的表现，而非肝火上炎证（A错）。肝阳上亢指肝阳亢扰于上，肝肾阴亏于下，以眩晕耳鸣、头目胀痛、面红、烦躁、腰膝酸软等为主要表现的证候。肝阳上亢证无“动摇”特点的症状，而患者出现站立不住、舌体颤动等症状为肝风内动的表现（B错）。热极生风证指邪热炽盛，热极动风，以高热、神昏、抽搐为主要表现的证候。患者没有出现高热、抽搐等肝经热盛症状（C错）。肝气郁结证指肝失疏泄，气机郁滞，以情志抑郁、胸胁或少腹胀痛等为主要表现的证候。而患者出现站立不住，舌体颤动等“风动”的症状及出现面赤等气血上壅的症状说明患者所患证型不是肝气郁结证（E错）。